如果根据生殖毒性试验和生殖发育毒性试验结果考虑某种受试物不必进行慢性毒性试验，可进行安全性评价，则其未观察到有害作用剂量应
A. 大于或等于人的可能摄入量的100倍
B. 大于或等于人的可能摄入量的300倍
C. 小于或等于人的可能摄入量的50倍
D. 小于人的可能摄入量的100倍
E. 小于人的可能摄入量的300倍

正确答案：B。大于或等于人的可能摄入量的300倍

解析：本题考查生殖毒性试验和生殖发育毒性试验的相关内容。如果根据生殖毒性试验和生殖发育毒性试验结果考虑某种受试物不必进行慢性毒性试验，可进行安全性评价，则其未观察到有害作用剂量应大于或等于人的可能摄入量的300倍（B对ACDE错）。